人体站立或半卧位时，腹膜腔最低的陷窝是
A. 肝肾隐窝
B. 盲肠后隐窝
C. 膀胱子宫陷凹
D. 直肠膀胱陷凹（男）或直肠子宫陷凹（女）
E. 无

正确答案：D。直肠膀胱陷凹（男）或直肠子宫陷凹（女）

解析：肝肾隐窝（A错）在仰卧位时,是腹膜腔的最低部位，站立或坐位时,男性的直肠膀胱陷凹,女性的直肠子宫陷凹（D对）是腹膜腔的最低部位。